可产生严重心律失常的是
A. 普萘洛尔
B. 庆大霉素
C. 异丙肾上腺素
D. 林可霉素
E. 己烯雌酚

正确答案：A。普萘洛尔

解析：本题考查普萘洛尔。普萘洛尔（A对）为β受体阻断剂，能够抑制窦房结，可能导致窦性心动过缓。庆大霉素（B错）属于氨基糖苷类抗菌药，其主要不良反应为肾毒性、耳毒性。异丙肾上腺素（C错）为β受体激动剂，常见不良反应为心悸、头晕、皮肤潮红等。林可霉素（D错）能抑制细菌的蛋白质合成，长期使用可致伪膜性肠炎。己烯雌酚（E错）是人工合成的非甾体雌激素物质，长期大量应用可诱发生殖系统恶性肿瘤。